某女性患者，7岁，1︱外伤冠折、切角缺损，即刻来院就诊。口腔检查：穿髓孔大、探痛（++），叩痛（±）。治疗首选活髓切断术，进行这种治疗成功的关键是
A. 保证病人无痛
B. 保持操作无菌
C. 止血彻底
D. 盖髓剂的选择
E. 拔髓彻底

正确答案：B。保持操作无菌

解析：本题考查活髓切断术的操作关键。活髓切断术目的是保存根部活髓，在操作过程中为防止牙髓组织再感染，应严格遵循无菌操作（B对）原则。在治疗过程中保证病人无痛（A错）、止血彻底（C错）、选择合适的盖髓剂（D错）是不可缺少的，但不是成功的关键。活髓切断的目的是为了保存根髓，不可彻底拔髓（E错）。